以下小儿生长发育的一般规律中，不正确的是
A. 由上至下
B. 由远到近
C. 由粗到细
D. 由简单到复杂
E. 由低级到高级

正确答案：B。由远到近

解析：生长发育一般遵循的一般规律：由上到下、由近到远、由粗到细、由低级到高级、由简单到复杂的规律。掌握“小儿生长发育规律”知识点。